根尖片可显示下列哪种牙髓病变
A. 急性牙髓炎
B. 牙髓充血
C. 牙髓坏死
D. 牙内吸收
E. 以上都不是

正确答案：D。牙内吸收

解析：本题考查根尖片。根尖片可显示牙内吸收（D对）的病变。牙髓在根尖片上显示的是低密度影，当牙髓坏死（C错）的时候，仍表现为低密度影，此时只能进行电活力测等进行判断，根尖片上没有显示。随着病情发展，当有牙内吸收或根尖炎（AB错）时，才可以通过根尖片加以诊断。